TA100检测
A. 碱基置换突变
B. 大段损伤
C. DNA交联
D. 正向突变
E. 移码突变

正确答案：A。碱基置换突变

解析：本题考查TA100检测的内容。Ames试验中TA100菌株用于检测碱基置换突变（A对BCDE错）。